关于阳性预测值正确的是
A. 试验检出阴性的人数占无病者总数的比例
B. 试验检出阳性的人数占有病者总数的比例
C. 筛检阴性者中真正成为非病人的可能性
D. 筛检阳性者中真正成为病人的可能性
E. 试验检出阳性的人数占无病者总数的比例

正确答案：D。筛检阳性者中真正成为病人的可能性

解析：本题考查阳性预测值的概念。阳性预测值是指筛检发现的阳性者中患目标疾病的人所占的比例（D对ABCE错）。